流行病学研究解决的问题不包括
A. 疾病的分布及其影响因素
B. 疾病的防制措施
C. 疾病病因
D. 增进人群健康的策略
E. 临床治疗

正确答案：E。临床治疗